附子的炮制加工品有
A. 白附片
B. 炮附片
C. 黑附片
D. 禹附片
E. 淡附片

正确答案：A、B、C、E。白附片；炮附片；黑附片；淡附片

解析：本题考查的是附子的炮制方法。附子的炮制加工品有白附片（A对）、炮附片（B对）、黑顺片（C对）与淡附片（E对）。附子的炮制品有：①盐附子；②黑顺片；③白附片；④炮附片；⑤淡附片。